枕左前位胎头进入骨盆入口时其衔接的径线是
A. 双顶径
B. 双颞径
C. 枕下前囟径
D. 枕额径
E. 枕颏径

正确答案：D。枕额径

解析：胎头双顶径进入骨盆入口平面，颅骨最低点接近或达到坐骨棘水平，称为衔接。分娩时，胎头取半俯屈状态以枕额径（D对）进入骨盆入口。